男，35岁。头痛伴视物模糊3个月，偶伴抽搐，曾在大便中发现带状节片。最可能的诊断是
A. 隐球菌性脑膜炎
B. 结核性脑膜炎
C. 病毒性脑膜炎
D. 脑肿瘤
E. 脑囊尾蚴病

正确答案：E。脑囊尾蚴病

解析：中年男性患者，头痛伴视物模糊3个月，偶伴抽搐，曾在大便中发现带状节片（说明患者有猪绦虫感染）最可能的诊断是脑囊尾蚴病（E对）。脑囊尾蚴病是由猪绦虫蚴虫（囊尾蚴）寄生脑组织形成包囊所致，临床表现与囊虫数量、大小及感染部位有关，本题患者应为脑实质型脑囊尾蚴病。隐球菌性脑膜炎（A错）起病隐匿，进展缓慢，早期有不规则低热，间歇性头痛，明显脑膜刺激征，粪便检查无明显异常。结核性脑膜炎（B错）患者可有明显结核中毒表现，查体可见脑膜刺激征，粪便中偶可发现结核杆菌。病毒性脑膜炎（C错）患者可有头痛、恶心、呕吐、轻偏瘫等表现，粪便检查多正常；脑肿瘤（D错）分为良性肿瘤和恶性肿瘤，良性肿瘤生长缓慢，局限在脑内，可引起颅内高压的症状；恶性肿瘤生长迅速，可发生转移，也可引起颅内高压症状，威胁生命，粪便检查无明显异常。